有关大叶性肺炎的描述，下列哪项错误
A. 肺泡腔内有细菌
B. 肺泡腔内有大量红细胞及白细胞
C. 肺泡壁充血，腔内有渗出液
D. 肺泡壁结构破坏
E. 肺泡腔内有纤维素可被机化

正确答案：D。肺泡壁结构破坏

解析：大叶性肺炎病原体先在肺泡引起炎症（A对），肺泡内浆液渗出（C对）及白细胞、红细胞浸润（B对），白细胞吞噬细菌，继而纤维蛋白渗出物溶解、吸收、肺泡重新通气，极个别患者肺泡内纤维蛋白吸收不完全，可形成机化性肺炎（E对）。最突出特点为病变消散后肺组织结构多无破坏，不留纤维瘢痕（D错，为本题正确答案）。